4岁男孩，妈妈在给穿衣服时牵拉左腕，患儿突然大哭，左肘功能障碍，左手不肯拿取玩物。其可能的诊断是
A. 左肘关节脱位
B. 左肱骨髁上骨折
C. 左肱骨内髁撕脱骨折
D. 左肱骨外髁撕脱骨折
E. 左桡骨头半脱位

正确答案：E。左桡骨头半脱位

解析：患儿有左腕牵拉史，左肘功能障碍，结合患者病史及临床表现，其可能的诊断是左桡骨头半脱位（E对）。桡骨头半脱位主要发生于有腕、手被向上牵拉受伤史的儿童，表现为肘部疼痛、活动受限。肘关节脱位（A错）时肘后三角关系会发生改变，检查可发现肘后突畸形，肘后空虚。患儿未出现骨折相关表现（BCD错）。